可屈手指的远侧指骨间关节的肌是
A. 指深屈肌
B. 指浅屈肌
C. 掌长肌
D. 旋前圆肌
E. 蚓状肌

正确答案：A。指深屈肌

解析：指深屈肌（A对）屈第2～5指指骨间关节和掌指关节，屈腕。指浅屈肌（B